接受双方当事人的财物违背了
A. 回避原则
B. 公正原则
C. 合议制原则
D. 医学会原则
E. 独立鉴定原则

正确答案：E。独立鉴定原则

解析：独立鉴定原则:专家鉴定组独立进行医疗事故技术鉴定，对医疗事故进行鉴别和判定，为处理医疗事故争议提供医学证据。任何单位或者个人不得干扰医疗事故技术鉴定工作，不得威胁、利诱、辱骂、殴打专家鉴定组成员。专家鉴定组成员不得接受双方当事人的财物或者其他利益。掌握“医疗事故的技术鉴定”知识点。